治疗阳气暴脱，可于神阙穴施
A. 灯草灸
B. 隔姜灸
C. 隔蒜灸
D. 隔盐灸
E. 隔泥灸

正确答案：D。隔盐灸

解析：灯草灸即灯火灸，具有疏风解表，行气化痰、清神止搐等作用，多用于小儿痄腮、小儿脐风和胃痛、腹痛、痧胀等病证（A错）。隔姜灸有温胃止呕，散寒止痛的作用，常用于因寒而致的呕吐、腹痛以及风寒痹痛等病证（B错）。隔蒜灸有清热解毒、杀虫的作用，多用于治疗瘰疬、肺痨及初起的肿疡等病证（C错）。隔盐灸有回阳、救逆、固脱的作用，多用于治疗伤寒阴证或吐泻并作、中风脱证等病证（D对）。针灸中无隔泥灸（E错）。